国家对医疗卫生机构实行的管理是
A. 分级
B. 分类
C. 严格
D. 分级分类
E. 监督

正确答案：B。分类